不侵犯中枢神经系统的病毒是
A. 单纯疱疹病毒
B. 水痘-带状疱疹病毒
C. 狂犬病病毒
D. 脊髓灰质炎病毒
E. 人乳头瘤病毒

正确答案：E。人乳头瘤病毒